体外循环抗凝血，宜选用
A. 肝素
B. 阿司匹林
C. 华法林
D. 双香豆素
E. 双香豆素乙酯

正确答案：A。肝素

解析：肝素（A对）在体内外均有强大的抗凝作用，与ATⅢ的赖氨酸残基形成可逆复合物，使ATⅢ结构发生变化，暴露活性中心，ATⅢ的赖氨酸残基迅速与丝氨酸蛋白酶活性中心的丝氨酸残基结合，从而加速ATⅢ对凝血因子Ⅱa、Ⅸa、Ⅹa、Ⅺa和Ⅻa等的灭活，临床可用于体外循环抗凝血。小剂量阿司匹林（B错）可抑制血小板环氧酶，减少前列腺素合成，减少血栓的形成，大剂量阿司匹林可抑制凝血酶原的形成，引起凝血障碍，加重出血倾向。华法林（C错）、双香豆素（D错）、双香豆素乙酯（E错）均属于香豆素类口服抗凝血药，其药理作用与临床应用基本相同，抑制肝脏维生素K环氧还原酶，阻止维生素K的环氧型向氢醌型转变，阻止了维生素K的再利用，影响凝血因子Ⅶ、Ⅸ、Ⅹ、Ⅱ的γ羧化，产生抗凝作用，临床用于血栓栓塞性疾病，还可作为心肌梗死的辅助药，亦可用于术后防止静脉血栓的发生，不用于体外抗凝。